多继发于长期使用广谱抗生素
A. 致病性大肠杆菌肠炎
B. 轮状病毒性肠炎
C. 生理性腹泻
D. 细菌性痢疾
E. 金黄色葡萄球菌肠炎

正确答案：E。金黄色葡萄球菌肠炎

解析：致病性大肠杆菌肠炎（A错）是由于病原性大肠埃希杆菌引起的。轮状病毒性肠炎（B错）是秋、冬季小儿腹泻最常见的病原体，是由轮状病毒引起的。生理性腹泻（C错）多见于婴儿，是由于其消化功能不全引起的。细菌性痢疾（D错）是由于感染志贺菌（痢疾杆菌）引起的。金黄色葡萄球菌肠炎（E对）是多继发于使用大量抗生素后，病程与症状常与菌群失调的程度有关，有时继发于慢性疾病的基础上。